男，40岁。双下肢水肿1个月。查体：BP150/100mmHg，尿红细胞3～5/HP，尿蛋白5g/d，血白蛋白20g/L，血肌酐70umol/L。近3天腰痛，尿量减少。复查尿常规尿红细胞30～50/HP。B超示右肾增大。为明确诊断，最重要的检查是
A. 肾血管彩超检查
B. 肾活检
C. 测尿钠排泄分数及尿渗透压
D. 尿培养
E. ANCA及抗GBM抗体检查

正确答案：A。肾血管彩超检查

解析：中年男性患者，尿红细胞3～5/HP（正常为0～3/HP，提示有血尿），尿蛋白5g/d（＞3.5g/d，提示有大量蛋白尿），血白蛋白20g/L（＜30g/L，提示有低白蛋白血症），双下肢水肿1个月（考虑为低白蛋白血症引起），BP150/100mmHg（正常为90～130/60～90mmHg，提示有高血压），综上所述患者最可能的诊断为肾病综合征，近3天腰痛、尿量减少，复查尿常规尿红细胞30～50/HP（提示肾静脉血栓形成）。综合患者的病史、临床表现、实验室检查，考虑诊断为肾病综合征。确诊肾静脉血栓形成（RVT）必须依靠选择性肾静脉造影检查（A对）。肾活检（B错）可以做出病理诊断，能够判断肾病的病理分型。测尿钠排泄分数及尿渗透压（C错）主要用于判断AKI的病因。尿培养（D错）主要用于尿路感染的诊断和指导治疗。ANCA及抗GBM抗体检查（E错）主要用于Ⅰ型和Ⅲ型急进性肾小球肾炎的诊断。